前列腺增生好发部位
A. 中央带
B. 移行带
C. 尿道
D. 外周带
E. 前纤维肌区域

正确答案：B。移行带